肉桂在真人养脏汤中的作用是
A. 温肾暖脾
B. 温肾纳气
C. 温通经脉
D. 温肾暖肝
E. 温脾暖胃

正确答案：A。温肾暖脾

解析：肉桂的功效为补火助阳，散寒止痛，温经通脉，引火归元。真人养脏汤方中重用罂粟壳涩肠止泻，为君药。臣以肉豆蔻温中涩肠；诃子苦酸温涩，功专涩肠止泻。君臣相须为用，体现“急则治标”，“滑者涩之”之法。然固涩之品仅能治标塞流，不能治本，故佐以肉桂温肾暖脾（A对），人参、白术补气健脾，三药合用温补脾肾以治本。泻痢日久，每伤阴血，甘温固涩之品，易壅滞气机，故又佐以当归、白芍养血和血，木香调气醒脾，共成调气和血，既治下痢腹痛后重，又使全方涩补不滞。甘草益气和中，调和诸药，且合参、术补中益气，合芍药缓急止痛，为佐使药。共奏涩肠固脱，温补脾肾之效，主治久泻久痢，脾肾虚寒证。